某男，37岁。长夏时节，天气由暑热突转阴雨连绵，因着衣不慎，遂致感冒。症见头痛昏重，胸膈满闷，脘腹胀痛，呕吐泄泻，舌苔白腻。证属外感风寒、内伤湿滞之感冒，接诊医师处以藿香正气水。服用2天后症状消失。藿香正气水处方的佐药是
A. 白芷、白术
B. 香薷、防风
C. 紫苏梗、防风
D. 香薷、白术
E. 白芷、紫苏叶油

正确答案：E。白芷、紫苏叶油

解析：本题考查的是藿香正气水的药物组成与方义简释。藿香正气水处方的佐药是白芷、紫苏叶油（E对）。藿香正气水：【药物组成】广藿香油、苍术、陈皮、厚朴（姜制）、紫苏叶油、白芷、茯苓、大腹皮、生半夏、甘草浸膏。藿香正气水为酊剂又含乙醇。【方义简释】方中广藿香油为广藿香的主要药用成分，性能功效与广藿香相似，其辛散芳化，微温除寒，既解表化湿，又理气和中，故为君药。苍术苦燥辛散，芳香温化，既燥湿而健脾，又散风寒而除痹发表；姜厚朴苦燥辛散，芳香温化，善燥湿、下气；生半夏辛散温燥，善燥湿化痰、降逆止呕；陈皮辛香行散，苦燥温化，善理气运脾、燥湿化痰；茯苓甘淡渗利兼补，平而不偏，善健脾利湿；大腹皮辛微温行散，善行气燥湿、除满消胀。六药相合，既燥湿利湿，又行气和中而运化除湿，以助君药内化湿浊而止吐泻，故为臣药。紫苏叶油为紫苏叶的主要药用成分，性效与紫苏叶相似，其辛微温发散，善发表散寒、行气宽中；白芷辛香行散，苦燥温化，善散风解表、燥湿。二药相合，助君臣药外散风寒而解表，内除湿理气而和中，故为佐药。甘草浸膏性能功效与甘草相同，其甘和缓，平偏凉，既和中，又调和诸药；藿香正气水含乙醇，其苦辛泄散，甘缓温助，善散寒通脉、行药势，均为使药。全方配伍，辛香温燥，共奏解表化湿、理气和中之功，故善治外感风寒，内伤湿滞或夏伤暑湿所致的感冒，症见头痛昏重、胸膈痞闷、脘腹胀痛、呕吐泄泻，也可用于胃肠型感冒见上述证候者。白术（AD错）、香薷（B错）、防风（C错）、紫苏梗不是藿香正气水的药物组成成分。